分泌性激素
A. 垂体
B. 肾上腺
C. 性腺
D. 甲状腺
E. 甲状旁腺

正确答案：B。肾上腺

解析：肾上腺实质由周边的皮质和中央的髓质两部分构成，其中，肾上腺（B对）皮质分泌盐皮质激素、糖皮质激素和性激素。